可诱发和加重哮喘的药物是
A. 硝酸甘油
B. 硝苯地平
C. 普萘洛尔
D. 胍乙啶
E. 洛伐他汀

正确答案：C。普萘洛尔

解析：本题考查普萘洛尔。普萘洛尔（C对）为非选择性β受体拮抗剂，阻断支气管平滑肌β受体引起支气管痉挛、诱发和加重哮喘。硝酸甘油（A错）为血管扩张药。硝苯地平（B错）为钙通道阻滞剂，可治疗高血压或心绞痛。胍乙啶（D错）为抗高血压药。洛伐他汀（E错）为他汀类降血脂药。